世界卫生组织环境空气质量标准规定未观察到直接或间接反应的浓度和接触时间属于
A. 环境空气质量一级标准
B. 环境空气质量二级标准
C. 环境空气质量三级标准
D. 环境空气质量四级标准
E. 尚无此类环境标准

正确答案：A。环境空气质量一级标准

解析：本题考查环境空气质量标准。世界卫生组织环境空气质量标准规定未观察到直接或间接反应的浓度和接触时间属于环境空气质量一级标准（A对BCDE错）。